男性，25岁，1年来牙龈逐渐肿大。检查发现：全口牙龈乳头及龈缘肿，上下前牙明显。龈乳头球状突起，前牙龈呈分叶状、质地坚硬，略有弹性，呈粉红色，不出血，无疼痛，龈沟加深，有菌斑，无分泌，11、21部分冠折断，已做根管治疗。为进一步确诊，首先需检查的项目是
A. 血象
B. X线片
C. 探诊附着丧失情况
D. 菌斑涂片检查
E. 牙合关系

正确答案：C。探诊附着丧失情况

解析：题干病例描述的表现主要为牙龈肥大增生的表现及口腔卫生状况，未描述牙周检查中最重要的内容：牙周袋及附着丧失情况，而这对于区别牙龈病及牙周炎是极为重要的指标，因此，为进一步确诊，首先需检查探诊附着丧失情况，该患者牙龈质地、颜色无异常，也无龈出血，因此血象不是首先要检查的项目。掌握“药物性牙龈肥大”知识点。